前列腺癌病人
A. 血CA19-9升高
B. 血PSA升高
C. 血CEA升高
D. 血AFP升高
E. 血酸性磷酸酶升高

正确答案：B。血PSA升高